十二指肠大乳头
A. 位于十二指肠下部的后内侧壁
B. 位于十二指肠降部的后内侧壁
C. 位于十二指肠上部的后壁
D. 位于十二指肠纵襞的上端
E. 有胆总管开口

正确答案：B。位于十二指肠降部的后内侧壁

解析：十二指肠大乳头位于十二指肠降部的后内侧壁(B对)的圆形隆起，有肝胰壶腹的开口(E错)。